主要用于疟疾病因性预防的药物是
A. 乙胺嘧啶
B. 奎宁
C. 氯喹
D. 青蒿素
E. 伯氨喹

正确答案：A。乙胺嘧啶

解析：本题考查乙胺嘧啶。主要用于疟疾病因性预防的药物是乙胺嘧啶（A对）。根据作用环节，抗疟药主要分以下几类：1.主要用于控制疟疾症状的抗疟药：氯喹（C错）、青蒿素（D错）及其衍生物、奎宁（B错）、甲氟喹、咯萘啶、本芴醇。2.主要用于控制疟疾复发和传播的抗疟药：伯氨喹（E错）。3.主要用于疟疾预防的抗疟药：乙胺嘧啶、磺胺类。